女性，74岁，阵发性胸痛2天，加重7小时，既往高血压10年，血清肌钙蛋白（-），心电图Ⅱ、Ⅲ、avF，V7～V9ST段抬高0.1-0.2mv，改善左心室重构需用
A. 阿司匹林
B. 培哚普利
C. 辛伐他汀
D. 硝酸异山梨酯
E. 硝普钠

正确答案：B。培哚普利

解析：患者女性，74岁，阵发性胸痛2天，加重7小时，既往高血压10年，血清肌钙蛋白（-），心电图Ⅱ、Ⅲ、avF，V7～V9ST段抬高0.1-0.2mv，提示为急性下壁心肌梗死，ACEI可以改善左心室重构（B对）。